温室效应可导致
A. 气温升高、海平面上升、病原体加速繁殖
B. 皮肤癌、白内障等疾病发病率上升
C. 眼睛刺痛、流泪、咽喉痛
D. 呼吸系统疾病、肺癌的发病率上升
E. 湖泊中水生生物死亡、建筑物腐蚀、森林枯萎

正确答案：A。气温升高、海平面上升、病原体加速繁殖

解析：本题考查温室效应的危害。大气层中某些气体如CO₂等能吸收地表发射的热辐射，使大气增温，称为温室效应。温室效应可导致气温升高、海平面上升、病原体加速繁殖（A对BCDE错）、与暑热相关疾病的发病率和死亡率增加等。